下列属于等张溶液的是
A. 0.85%NaCl
B. 0.85%葡萄糖
C. 1.9%尿素
D. 5%NaCl
E. 10%葡萄糖

正确答案：A。0.85%NaCl

解析：正常血浆渗透压为290～310mmol/L，渗透压与血浆渗透压相等的溶液为等渗溶液，如果其溶质不能自由通过细胞膜则称为等张溶液。0.85％NaCl（A对D错）的渗透压约为308mmol/L，其能够使悬浮于其中的红细胞保持正常形态和大小，且NaCl不能自由透过细胞膜，既是等渗溶液也是等张溶液。5%葡萄糖（BE错）的渗透压与血浆渗透压大致相等，为等渗溶液，但葡萄糖可以改变细胞内外渗透压，不能使细胞保持正常形态，故不是等张溶液。1.9%尿素（C错）虽是等渗溶液，但因为尿素能自由通过细胞膜，所以不是等张溶液。